下列中毒性细菌性痢疾的治疗措施，错误的是
A. 抗菌治疗
B. 抗休克
C. 防治脑水肿
D. 防治呼吸衰竭
E. 手术治疗

正确答案：E。手术治疗

解析：中毒性痢疾临床上以严重毒血症状、休克和∕或中毒性脑病为主，应积极采取有针对性的综合措施予以及时抢救，一般不需要手术治疗（E错，为本题正确答案）。治疗措施主要包括：病原治疗，采用有效抗生素静脉滴注进行抗菌治疗（A对），如环丙沙星、左氧氟沙星等；针对休克型要进行抗休克（B对）治疗，要扩充血容量，纠正酸中毒，改善微循环障碍；针对脑型，应用甘露醇，快速静脉滴注以防治脑水肿（C对），此型患者应保持呼吸道通畅，吸氧，防治呼吸衰竭（D对），必要时予以山梗菜碱、尼克刹米等呼吸兴奋剂。重症患者可应用呼吸机辅助呼吸。